在显性致死试验中，乙基甲磺酸酯可使早期死亡胚胎平均数显著增加并有剂量-反应关系，故定为阳性结果，其致突变机制为
A. 体细胞基因突变
B. 体细胞染色体畸变
C. 哺乳动物细胞正向突变
D. 生殖细胞基因突变
E. 生殖细胞染色体畸变

正确答案：E。生殖细胞染色体畸变